聚氧乙烯脱水山梨醇单油酸酯的商品名称是
A. 吐温20
B. 吐温40
C. 吐温80
D. 司盘60
E. 司盘85

正确答案：C。吐温80

解析：本题考查聚氧乙烯脱水山梨醇单油酸酯的商品名。聚氧乙烯脱水山梨醇单油酸酯的商品名为吐温80（C对）；吐温20（A错）为聚氧乙烯失水山梨醇单月桂酸酯；吐温40（B错）为聚氧乙烯山梨糖醇酐单棕榈酸酯；司盘60（D错）为山梨醇酐单硬脂酸酯；司盘85（E错）为山梨醇酐三油酸酯。